在喉口两侧异物易滞留的部位是
A. 咽隐窝
B. 扁桃体窝
C. 梨状隐窝
D. 以上都是
E. 以上都不是

正确答案：C。梨状隐窝

解析：梨状隐窝(C对)位于喉口两侧，为异物容易滞留的部位。咽隐窝(A错)位于鼻咽，是鼻咽癌的好发部位，扁桃体窝(B错)位于口咽，细菌容易在此繁殖，导致感染。